急性毒性替代试验不包括
A. 固定剂量法
B. 定期递增剂量法
C. 急性毒性分级法
D. 限量试验
E. 上-下法

正确答案：B。定期递增剂量法